口腔临床医疗实践中，口腔科医师判断一种新技术的诊疗效果，最常用的方法是
A. 横断面研究
B. 组群研究
C. 临床试验
D. 病例对照研究
E. 纵向研究

正确答案：C。临床试验

解析：在口腔临床医疗实践中，口腔科医师经常会遇到判断新技术、新药物或新方法效果的经历，而判断这些效果的最常用的方法就是临床试验。掌握“口腔临床试验方法”知识点。